患儿，14岁，体重50kg，体温38.7℃，使用布洛芬退热，单次给药剂量是
A. 200～400mg
B. 500～1000mg
C. 300～600mg
D. 10～15mg
E. 100～150mg

正确答案：A。200～400mg

解析：本题考查布洛芬的用量。布洛芬具有解热镇痛抗炎作用。成人及12岁以上儿童的给药剂量为一次200～400mg（A对），一日3～4次；1～12岁儿童，每次5～10mg/kg，每日3次。